目前普查原发性肝癌的最好方法是
A. 超声波检查
B. 甲胎球蛋白放射免疫测定
C. 放射性核素扫描
D. 肝功能检查
E. X线检查

正确答案：B。甲胎球蛋白放射免疫测定

解析：一般来说如果甲胎蛋白超过200，持续八个月，肿瘤的可能性就很大，就需要进行肝脏彩超或者肝脏磁共振等方面的检查，排除一些肝脏肿瘤的可能性。故目前普查原发性肝癌的最好方法是甲胎球蛋白放射免疫测定（B对）。超声波检查，根据示波屏上显示的回波的距离、弱强和多少，以及衰减是否明显，可以显示体内某些脏器的活动功能，并能确切地鉴别出组织器官是否含有液体或气体，或为实质性组织（A错）。放射性核素扫描是临床检查和研究一些肺部疾病和测定肺的灌注及通气功能的方法（C错）。肝功能检查是通过各种生化试验方法检测与肝脏功能代谢有关的各项指标、以反映肝脏功能基本状况的检查（D错）。胸部X线检查：主要用于肺炎行实变、纤维化、钙化、肿块、肺不张、肺间质病变、肺气肿、空洞、支气管炎症及扩张、胸腔积液、气胸、胸膜肥厚粘连、纵膈肿瘤、心脏、血管性态、乳房肿块诊断（E错）。